经产妇，26岁。妊娠37周，晨起发现阴道流血，无明显腹痛，检查有宫缩，查体子宫大小大于孕周数，胎心存在。本例最适合的处置措施是
A. 阴道分娩
B. 行剖宫产术
C. 引产
D. 静滴缩宫素
E. 人工破膜

正确答案：B。行剖宫产术

解析：青年经产妇，妊娠37周（妊娠28周及以后称为妊娠晚期），晨起发现阴道流血，无明显腹痛（前置胎盘的典型症状为妊娠晚期或临产时，发生无诱因、无痛性反复阴道流血），最可能诊断为前置胎盘，该孕妇妊娠37周（＞34周），最适合的处置措施是行剖宫产术（B对）（适用于胎龄达妊娠36周以上，短时间内不能结束分娩）。阴道分娩（A错）适用于边缘性前置胎盘、枕先露、阴道流血不多、无头盆不称和胎位异常，估计在短时间内能结束分娩者。引产（C错）和人工破膜（E错），是在阴道试产不顺利的情况下予以实施。该孕妇无临产迹象，不应静滴缩宫素（D错）。